在分析流行病学研究的设计阶段，最有可能出现的偏倚是
A. 选择偏倚
B. 信息偏倚
C. 混杂偏倚
D. 失访偏倚
E. 随机偏倚

正确答案：A。选择偏倚

解析：本题考查分析流行病学中的偏倚。无论是队列研究还是病例对照研究，较容易出现的偏倚为选择偏倚、信息偏倚和混杂偏倚。在分析流行病学研究的设计阶段，最容易出现的偏倚为选择偏倚（A对BCDE错）。